检查羊水，提示胎儿肺成熟的结果是
A. 卵磷脂/鞘磷脂比值为2.3
B. 淀粉酶值为500U/L
C. 胆红素类物质值为0.01
D. 含脂肪细胞出现率为23%
E. 肌酐值为2.3mg

正确答案：A。卵磷脂/鞘磷脂比值为2.3

解析：羊水中卵磷脂/鞘磷脂比值＞2（A对），提示胎儿肺成熟。淀粉酶≥450U/L（B错）提示胎儿唾液腺成熟。胆红素类物质值＜0.02（C错），提示胎儿肝成熟。含脂肪细胞出现率达20％（D错），提示胎儿皮肤成熟。肌酐值≥176.8µmol/L（2mg%）（E错），提示胎儿肾成熟（八年制妇产科学第2版P57）。